循证医学实践的核心是
A. 素质良好的临床医生
B. 最佳的研究证据
C. 临床流行病学基本方法和知识
D. 患者的参与和合作
E. 必要的医疗环境和条件

正确答案：B。最佳的研究证据